男，59岁，2型糖尿病12年。空腹血糖5.6mmol/L，餐后2小时血糖14.6mmol/L，糖化血红蛋白7.06%。3年前眼底检查可见微血管瘤和出血，近2月来视力明显减退，眼底检查可见棉絮状软性渗出，目前糖尿病视网膜病变已进展为
A. Ⅱ期
B. Ⅲ期
C. Ⅳ期
D. Ⅴ期
E. Ⅰ期

正确答案：B。Ⅲ期

解析：糖尿病视网膜改变可分六期。Ⅰ期：微血管瘤、小出血点（E错）；Ⅱ期：出现硬性渗出（A错）；Ⅲ期：出现棉絮状软性渗出（B对）；Ⅳ期；新生血管形成、玻璃体积血（C错）；V期：纤维血管增殖、玻璃体机化（D错）；Ⅵ期：牵拉性视网膜脱离、失明。